氯吡格雷应避免与奥美拉唑联合应用，因为两者竞争共同的肝药酶，该肝药酶是
A. CYP2B6
B. CYP2C19
C. CYP2D6
D. CYP2E1
E. CYP1A2

正确答案：B。CYP2C19

解析：本题考查药物的相互作用。奥美拉唑既是CYP2C19（B对）的底物，又是CYP2C19强抑制剂，氯吡格雷体内经CYP2C19代谢发挥抗血小板作用，两者同服，会降低氯吡格雷的疗效。